以下不属于致病性葡萄球菌特征的是
A. 菌落色素为金黄色，并产生透明溶血环
B. 镜检符合葡萄球菌的形态和染色特征
C. 血浆凝固酶阴性
D. 甘露醇发酵阳性
E. 耐热核酸酶检测阳性

正确答案：C。血浆凝固酶阴性

解析：致病性葡萄球菌（金葡菌）的特征：①镜检符合葡萄球菌的形态和染色特征；②菌落色素为金黄色，并产生透明溶血环（完全溶血或称β溶血）；③血浆凝固酶阳性；④甘露醇发酵阳性；⑤耐热核酸酶检测阳性。掌握“葡萄球菌属”知识点。